小腿前群肌
A. 位于胫骨前方
B. 有胫骨前肌和趾长屈肌
C. 伸膝关节和伸踝关节
D. 屈踝关节和屈膝关节
E. 胫骨前肌可使足内翻

正确答案：E。胫骨前肌可使足内翻

解析：小腿前群肌位于胫骨和腓骨前方，而非仅位于胫骨前方（A错），有胫骨前肌，而趾长屈肌属小腿后群肌，而非小腿前群肌（B错），伸踝关节，不伸膝关节（C错），不屈踝关节和屈膝关节（D错），胫骨前肌可使足内翻（E对）。